手三阴经的走向是
A. 从手走头
B. 从胸走手
C. 从头走足
D. 从足走腹
E. 从手走足

正确答案：B。从胸走手

解析：十二经脉的循行走向总的规律是手三阳经从手走头（A错），手三阴经从胸走手（B对）；足三阳经从头走足（C错），足三阴经从足走腹胸（D错）；经脉循行中没有从手走足（E错）的经脉。